消化性溃疡发病机制中最重要的攻击因子是
A. 胃酸、胃蛋白酶
B. 胆汁
C. 精神、心理因素
D. 胰酶
E. 食物的理化刺激

正确答案：A。胃酸、胃蛋白酶

解析：消化性溃疡发病的机制是胃酸、胃蛋白酶的侵袭作用与黏膜的防御能力间失去平衡，胃酸对黏膜产生自我消化。发病机制中最重要的攻击因子是胃酸、胃蛋白酶（A对）。胰酶（D错）、胆汁（B错）会随十二指肠-胃反流过程反流入胃，对黏膜有一定的损伤作用；精神、心理因素（C错）与食物的理化刺激（E错）也可导致黏膜损伤，引发消化性溃疡，但几率较小。